机体活动时直接利用的能量是
A. ATP
B. ADP
C. 碳水化合物
D. 脂肪
E. 蛋白质

正确答案：A。ATP